塑料制品燃烧时产生的环境激素有哪些
A. PCDD
B. 双酚A
C. 壬酚
D. DDT
E. A＋C

正确答案：A。PCDD

解析：本题考查塑料制品燃烧时产生的环境激素。PCDD为多氯代二噁英，塑料制品燃烧时会产生大量的环境毒物如二噁英（A对BCDE错）。